治疗厌食脾胃气虚的首选方剂是
A. 资生健脾丸
B. 疳积散
C. 健脾丸
D. 曲麦枳洙丸
E. 异功散

正确答案：E。异功散

解析：厌食脾胃气虚证多见于脾胃素虚，或脾运失健迁移失治者；临床以不思乳食，面色少华，肢倦乏力和形体偏瘦为特征；治宜健脾益气，佐以助运；方选异功散（E对）。资生健脾丸具有健脾开胃，消食止泻，调和脏腑，滋养营卫之功效。主治胃脾虚弱，食不运化，胸脘饱满，面黄肌瘦，大便溏泄，以及妇人妊娠呕吐，小儿疳积，神疲便溏（A错）。疳积散具有消积化滞之功效。主治食滞脾胃所致的疳症，症见不思乳食、面黄肌瘦、腹部膨胀、消化不良（B错）。健脾丸具有健脾消食之功效。主治脾虚食积证。症见食少难消，脘腹痞闷，体倦少气，舌淡苔白，脉虚弱（C错）。曲麦枳术丸健脾消食。用于脾虚停滞，脘腹痞满，倒饱嘈杂，不思饮食（D错）。